可用于治疗非何杰金（非霍奇金）淋巴瘤的单克隆抗体是
A. 曲妥珠单抗
B. 利妥昔单抗
C. 贝伐单抗
D. 西妥昔单抗
E. 英夫利昔单抗

正确答案：B。利妥昔单抗

解析：本题考查单克隆抗体的适应证。利妥昔单抗（B对）用于复发或耐药的滤泡性中央型淋巴瘤，未经治疗的CD₂O阳性Ⅲ～Ⅳ期滤泡性非何杰金淋巴瘤。曲妥珠单抗（A错）用于人表皮生长因子受体-2过度表达的转移性乳腺癌。贝伐单抗（C错）用于结肠癌、肺癌、肾癌和脑癌。西妥昔单抗（D错）与伊立替康联用治疗表达表皮生长因子受体，经伊立替康治疗失败的转移性结直肠癌。英夫利昔单抗（E错）用于克罗恩病，类风湿关节炎，溃疡性结肠炎。